对人体有潜在威险，对其安全性有效性必须严格控制的医疗器械
A. 助听器
B. 内窥镜
C. 一次性使用注射器
D. 医用脱脂棉
E. 体外震波碎石机

正确答案：C、E。一次性使用注射器；体外震波碎石机

解析：本题考查医疗器械的分类。对人体有潜在威险，对其安全性有效性必须严格控制的医疗器械有一次性使用注射器（C对）、体外震波碎石机（E对）。第三类医疗器械是最高级别的医疗器械，必须严格控制的医疗器械，指植入人体，用于支持、维持生命，对其安全性、有效性必须严格控制的医疗器械。第三类医疗器械有：植入式心脏起搏器、体外震波碎石机、病人有创监护系统、人工晶体、有创内窥镜、超声手术刀、彩色超声成像设备、激光手术设备、高频电刀、微波治疗仪、医用核磁共振成像设备、一次性使用无菌注射器、一次性使用输液器、输血器、CT设备等。第一类医疗器械：通过常规管理足以保证其安全性、有效性的医疗器械。如手术器械的大部分、听诊器、医用X线胶片、医用X线防护装置、全自动电泳仪、医用离心机、切片机、牙科椅、煮沸消毒器、纱布绷带、创可贴、手术衣、手术帽、口罩、集尿袋等。第二类医疗器械对其安全性、有效性应当加以控制的医疗器械。如体温计、血压计、心电诊断仪器、光学内镜（B错）、牙科综合治疗仪、医用脱脂棉（D错）等。